关于病因概念叙述哪项不正确
A. 引起疾病的病因
B. 与疾病发生有关的所有因素
C. 包括直接因素和间接因素
D. 是与疾病发生有直接关系的致病因子
E. 某些因素的存在或减少，疾病发生的频率增加或减少

正确答案：D。是与疾病发生有直接关系的致病因子